男，14岁。颈淋巴结肿大2周，活检示淋巴结结构破坏，可见里-斯细胞。可诊断为
A. 传染性单核细胞增多症
B. 淋巴结反应性增生
C. 霍奇金病
D. 非霍奇金淋巴瘤
E. 淋巴结结核

正确答案：C。霍奇金病

解析：患者青少年男性，以颈部淋巴结肿大为主要表现（霍奇金淋巴瘤旧称霍奇金病，首发症状常是无痛性颈部或锁骨上淋巴结肿大），淋巴结活检：结构破坏，可见里-斯细胞（里-斯细胞即R-S细胞对霍奇金病的病理组织学诊断有重要价值），提示患者霍奇金病（C对）可能性大。传染性单核细胞增多症（A错）也可见里-斯细胞，但无诊断意义；淋巴结反应性增生（B错）、非霍奇金淋巴瘤（D错）和淋巴结结核（E错）可有淋巴结肿大，但不会出现里-斯细胞。